建设项目的环境影响报告书不包括
A. 建设项目概况
B. 建设项目对环境可能造成影响的分析、预测和评估
C. 建设项目用地情况
D. 建设项目环境保护措施及其技术、经济论证
E. 对建设项目实施环境监测的建议

正确答案：C。建设项目用地情况

解析：本题考查建设项目的环境影响报告书的内容。建设项目的环境影响报告书应当包括：①建设项目概况（A对）；②建设项目周围环境现状；③建设项目对环境可能造成影响的分析、预测和评估（B对）；④建设项目环境保护措施及其技术、经济论证（D对）；⑤建设项目对环境影响的经济损益分析；⑥对建设项目实施环境监测的建议（E对）；⑦环境影响评价的结论。建设项目用地情况（C错，为本题正确答案）不是建设项目的环境影响报告书的内容。